粉末直接压片的助流剂是
A. 乙基纤维素
B. 甲基纤维素
C. 微晶纤维素
D. 羟丙基纤维素
E. 微粉硅胶

正确答案：E。微粉硅胶

解析：本题考查片剂的常用辅料。微粉硅胶（E对）是粉末直接压片的助流剂。润滑剂（广义）按作用不同可以分为三类：助流剂、抗黏剂和润滑剂（狭义），其中助流剂的作用为降低颗粒之间的摩擦力，改善粉体流动性，有助于减少重量差异。常用的助流剂有微粉硅胶、滑石粉等。乙基纤维素（A错）、甲基纤维素（B错）、微晶纤维素（C错）和羟丙基纤维素（D错）是片剂中常用的黏合剂。